单纯肩关节前脱位手法复位后应立即采取的措拖是
A. 持续牵引
B. 三角巾悬吊
C. 肩关节功能锻炼
D. 石膏外固定
E. 夹板外固定

正确答案：B。三角巾悬吊

解析：单纯肩关节前脱位手法复位后应立即采取的措拖是三角巾悬吊（B对）。解除固定后，应注意肩关节功能锻炼（C错）。